易在体外生长繁殖真核细胞型微生物是
A. 真菌
B. 病毒
C. 支原体
D. 衣原体
E. 放线菌

正确答案：A。真菌

解析：真核细胞型微生物（真菌）为多细胞或单细胞微生物，其细胞分化完善，有细胞核和各种细胞器，故易在体外生长繁殖。掌握“微生物定义、分类及特点”知识点。